属于边缘封闭区
A. 上颌牙槽嵴顶
B. 磨牙后垫
C. 切牙乳突
D. 颊侧前庭
E. 颊系带

正确答案：B。磨牙后垫

解析：本题考查无牙颌的功能分区。根据无牙颌的组织结构特点和全口义齿的关系，将无牙颌分为四个区，即主承托区、副承托区、边缘封闭区和缓冲区。主承托区的临床意义在于承担义齿的大部分咀嚼压力，副承托区主要辅助主承托区承担小部分的咀嚼压力，缓冲区主要为了在部分区域进行充分缓冲，避免义齿修复后出现黏膜压痛，边缘封闭区与义齿的固位密切相关。边缘封闭区是义齿边缘接触的软组织部分，如黏膜皱襞、系带附着部、上颌后堤区和下颌磨牙后垫（B对）。上颌牙槽嵴顶（A错）属于主承托区。切牙乳突（C对）属于缓冲区。颊侧前庭（D对）属于副承托区。为了不影响义齿的固位，全口义齿应在颊系带（E错）的部位进行相应的缓冲。